肠管壁疝嵌顿易误诊的原因，下列哪一项不正确
A. 局部肿块不明显
B. 嵌顿疝内容物为大网膜
C. 无肠梗阻表现
D. 不易引起绞窄
E. 临床上少见

正确答案：B。嵌顿疝内容物为大网膜

解析：肠管壁疝又称Richter疝，属于嵌顿性疝，临床上少见（E对）。由于疝内容物仅为部分肠壁（B错，为本题正确答案），局部肿块不明显（A对），一般无肠梗阻表现（C对），且不容易引起绞窄（D对）等原因，肠管壁疝嵌顿时容易误诊。